体温在39℃以上，24小时内波动＜1℃，这种热型为
A. 弛张热
B. 间歇热
C. 稽留热
D. 波状热
E. 不规则热

正确答案：C。稽留热

解析：患者体温在39℃以上，24小时内波动＜1℃，符合稽留热（体温恒定维持在39～40℃以上的高水平，达数天或数周，24小时内体温波动范围不超过1℃）（C对）。弛张热（A错）又称败血症热型，体温常在39℃以上，波动幅度大，24小时内波动范围超过2℃，但都在正常水平以上。间歇热（B错）是指体温骤升达高峰后持续数小时，又迅速降至正常水平，无热期（间歇期）可持续1天到数天，如此高热期与无热期反复交替出现。波浪热（D错）是指体温逐渐上升达39℃或以上，数天后又逐渐降至正常水平，持续数天后又逐渐升高，如此反复多次。不规则热（E错）的发热体温曲线无一定规律。